女，1岁。急起高热、流涎、厌食。查体：见咽部充血，咽腭弓、悬雍垂、软腭等处可见2~4mm大小的疱疹，心肺（-）。导致患儿发病的病原为
A. 柯萨奇病毒
B. 带状疱疹病毒
C. 腺病毒
D. 人类疱疹病毒6型
E. 合胞病毒

正确答案：A。柯萨奇病毒

解析：女性幼童患者，急起高热、流涎、厌食。查体：见咽部充血，咽腭弓、悬雍垂、软腭等处可见2~4mm大小的疱疹，心肺（-），综合患者的症状、体征最可能的诊断是疱疹性咽峡炎，其大部分为柯萨奇病毒（A对）感染所致。带状疱疹病毒是水痘的病原体（B错）。腺病毒（C错）可感染呼吸道、胃肠道、尿道和膀胱等部位，引起不同疾病。人类疱疹病毒6型（HHV-6）（D错）感染持续终生，多为隐性感染，少数可导致幼儿急疹（玫瑰疹）。合胞病毒（E错）感染可引起肺炎。